某女，26岁，平素痛经，半年来又患风湿痹痛，拘挛麻木，宜选用的药是
A. 丹参
B. 五灵脂
C. 红花
D. 乳香
E. 水蛭

正确答案：D。乳香

解析：本题考查的是乳香的主治病证。平素痛经，半年来又患风湿痹痛，拘挛麻木，宜选用的药是乳香（D对）。乳香：【主治病证】（1）痛经，闭经，产后瘀阻腹痛，胸胁脘腹刺痛，跌打伤痛。（2）风湿痹痛、拘挛麻木。（3）肠痈，疮疡肿痛或溃久不收口。丹参（A错）：【主治病证】（1）月经不调，血滞闭经，产后瘀滞腹痛。（2）胸痹心痛，脘腹疼痛，癥瘕积聚，肝脾肿大，热痹肿痛。（3）热病高热烦躁，内热心烦，斑疹，心悸怔忡，失眠。（4）疮痈肿痛。五灵脂（B错）：【主治病证】（1）血滞痛经、闭经，产后瘀阻腹痛，胸胁脘腹刺痛。（2）瘀滞崩漏。（3）蛇虫咬伤。红花（C错）：【主治病证】（1）血滞闭经、痛经，产后恶露不尽。（2）胸痹心痛，癥瘕积聚，跌打肿痛。（3）斑疹色暗（配清热凉血解毒药）。水蛭（E错）：【主治病证】血滞闭经，癥瘕积聚，跌打损伤。